某厂与居住区的卫生防护距离内设有消防站、车库、浴室、体育场及污水泵站，其中不应设置的是
A. 消防站
B. 体育场
C. 浴室
D. 污水泵站
E. 车库

正确答案：B。体育场

解析：本题考查卫生防护距离范围内的设置。卫生防护距离是指产生有害因素车间的边界至居住区边界的最小距离。卫生防护距离范围内应尽量绿化，也可设置消防站（A对）、污水泵站（D对）、车库（E对）、浴室（C对）等非居住性建筑物，但不得修建公园、体育场（B错，为本题正确答案）、学校和住宅建筑。